用于类风湿关节炎治疗的改变病情抗风湿药联合治疗方案是
A. 甲氨蝶呤+来氟米特
B. 双氯芬酸钠+来氟米特
C. 甲氨蝶呤+硫酸氨基葡萄糖
D. 对乙酰氨基酚+硫酸氨基葡萄糖
E. 双氯芬酸钠+强的松

正确答案：A。甲氨蝶呤+来氟米特

解析：改变病情抗风湿药：该类药物较NSAIDs发挥作用慢，临床症状的明显改善大约需1～6个月，有改善和延缓病情进展的作用。RA一经确诊，都应早期使用DMARDs药物，药物的选择和应用的方案要根据患者病情活动性、严重性和进展而定，视病情可单用也可采用两种及以上DMARDs药物联合使用。甲氨蝶呤（MTX）应作为RA的首选用药，并将它作为联合治疗的基本药物。来氟米特同样属于改变病情抗风湿药物，主要抑制合成嘧啶的二氢乳清酸脱氢酶，使活化淋巴细胞的生长受抑。口服每日10～20mg，与MTX（甲氨蝶呤）有协同作用，常联合使用（A对）。双氯芬酸钠及对乙酰氨基酚属于非甾体抗炎药（BDE错）。